关于抑癌基因的叙述，下列哪项正确
A. 发出抗细胞增生信号
B. 与癌基因表达无关
C. 缺失对细胞的增生、分化无影响
D. 不存在于人类正常细胞
E. 肿瘤细胞出现时才进行表达

正确答案：A。发出抗细胞增生信号